根据《处方管理办法》，处方前记应注明的是
A. 药品金额
B. 临床诊断
C. 药品名称
D. 药品性状
E. 用法用量

正确答案：B。临床诊断

解析：本题考察处方管理。处方前记应注明临床诊断（B对）。